脂溶性药物依靠药物分子在膜两侧的浓度差，从膜的高浓度一侧向低浓度一侧转运药物的方式是
A. 膜动转运
B. 简单扩散
C. 主动转运
D. 滤过
E. 易化扩散

正确答案：B。简单扩散

解析：本题考查药物的转运方式。脂溶性药物依靠药物分子在膜两侧的浓度差，从膜的高浓度一侧向低浓度一侧转运药物的方式是简单扩散（B对）；膜动转运（A错）是细胞膜通过主动变形将某些物质摄入细胞内或从细胞内释放到细胞外的过程；主动转运（C错）是逆浓度梯度运输的过程；滤过（D错）是指水溶性小分子物质依靠膜两侧的流体静压或渗透压通过孔道的过程；易化扩散（E错）是需要借助载体的被动运输过程。